在突发公共卫生事件流行病学调查方法中，暴发调查是其中的一个基本形式，而现场调查更是核心，下列不是现场调查的内容的是
A. 三间分布调查
B. 个案调查
C. 区域的确定和划分
D. 病原体检测
E. 病例定义

正确答案：C。区域的确定和划分

解析：本题考查现场调查的内容。现场调查内容包括病例定义（E对）、描述疾病的三间分布（A对）、个案调查（B对）、病原体检测（D对）等。区域的确定和划分（C错，为本题正确答案）属于现场调查前的准备和组织工作。